围生期（围产期）国内采用的定义是指
A. 胎龄满27周至出生后7足天
B. 胎龄满27周至出生后15足天
C. 胎龄满28周至出生后7足天
D. 胎龄满28周至出生后15足天
E. 胎龄满29周至出生后15足天

正确答案：C。胎龄满28周至出生后7足天

解析：围生期（围产期）指妊娠满28周（即胎儿体重≥1000g或身长≥35cm）至产后7足天（C对）。